检查右旋糖酐-40氯化钠的分子量与分子分布的方法是
A. 分子排阻色潽法
B. 四氮唑比色法
C. 抗生素微生物法
D. 氧瓶燃烧比色法
E. 红外分光光度法

正确答案：A。分子排阻色潽法

解析：本题考查分子排阻色谱法。检查方法：取本品适量，加流动相制成每1ml中约含10mg的溶液，振摇，室温放置过夜，作为供试品溶液。另取4～5个已知分子量的右旋糖酐对照品，同法制成每1ml中各含10mg的溶液作为对照品溶液。照分子排阻色谱法，以亲水性球型高聚物为填充柱，以0.71%硫酸钠溶液（内含0.02%叠氮化钠）为流动相，柱温35℃，流速为每分钟0.5ml，示差折光检测器检测。称取葡萄糖和葡聚糖2000适量，分别加流动相溶解并稀释制成每1ml中约含10mg的溶液，取20μl注入液相色谱仪，测得保留时间tT和t0；供试品溶液和对照品溶液色谱图中主峰的保留时间tR均应在tT和盂t0之间。理论板数按葡萄糖峰计算不小于5000。